筛检试验是
A. 对人群中的早期患者作出诊断
B. 早期发现患者或高危个体的一种措施
C. 评价筛检试验的真实性
D. 评价筛检试验的可靠性
E. 了解筛检试验和金标准在诊断患者方面的符合程度

正确答案：B。早期发现患者或高危个体的一种措施